可阻断肺胸膜的牵张感受器产生的肺迷走神经反射，适用于各种原因引起的刺激性干咳的药物是
A. 喷托维林
B. 苯丙哌林
C. 可待因
D. 右美沙芬
E. 羧甲司坦

正确答案：B。苯丙哌林

解析：本题考查苯丙哌林。可阻断肺胸膜的牵张感受器产生的肺迷走神经反射，适用于各种原因引起的刺激性干咳的药物是苯丙哌林（B对）。苯丙哌林主要抑制肺和胸膜牵张感受器引起的肺-迷走神经反射，也能抑制咳嗽中枢，是兼有外周和中枢作用的强效镇咳药。喷托维林（A错）选择性抑制延髓咳嗽中枢，并具有微弱的阿托品样作用，适用于各种原因引起的无痰干咳。可待因（C错）适用于无痰剧烈干咳，对胸膜炎干咳伴胸痛患者尤为适用。右美沙芬（D错）用于各种原因引起的干咳，包括上呼吸道感染（如感冒和咽炎）、支气管炎等引起的咳嗽。羧甲司坦（E错）属于黏痰调节剂类祛痰药。